糖皮质激素不用于
A. 急性粟粒性肺结核
B. 血小板减少症
C. 中毒性休克
D. 骨质疏松
E. 脑（腺）垂体前叶功能减退

正确答案：D。骨质疏松

解析：糖皮质激素作用广泛而复杂，临床应用较广：1严重感染或炎症包括急性粒性肺结核（A对），常可迅速缓解症状，减轻症状，保护心脑等重要器官，从而帮助患者度过危险期；大剂量使用糖皮质激素在应用足量有效抗生素治疗的前提下，可加用糖皮质激素药物作为辅助治疗，但病毒感染除外，因为目前尚无抗病毒的特效药以免因用后机体防御能力降低而使感染扩散而加剧。2免疫相关疾病：自身免疫性疾病，过敏性疾病，器官移植排斥反应。3抗休克治疗，对感染中毒性休克，在有效的抗菌药治疗下，可及时、短时间突击使用大剂量糖皮质激素（C对）。4血液病，可用于治疗血小板减少症（B对），多用于治疗儿童急淋。5局部应用。6替代疗法，用于急慢性肾上腺皮质功能不全者，脑垂体前叶功能减退（E对）。骨质疏松及椎体压缩性骨折是应用糖皮质激素治疗中非常严重的合并症（D错，为本题正确选项），治疗开始时要做好保护患者骨丢失预防用药。